戊型肝炎病毒的主要传播途径是
A. 粪—口传播
B. 血液传播
C. 虫媒传播
D. 呼吸道传播
E. 直接接触传播

正确答案：A。粪—口传播

解析：戊型肝炎病毒的主要传播途径是粪—口传播（A对）。丙型病毒性肝炎、丁型病毒性肝炎的传播途径主要是输血或血制品传播（B错）。虫媒传播（C错）是乙脑等疾病的传播途径。呼吸道传播（D错）不是肝炎的传播途径。直接接触传播（E错）是丙肝的传播途径之一。